心包摩擦音通常在什么部位听诊最清楚
A. 心尖部
B. 心底部
C. 胸骨左缘第3、4肋间
D. 胸骨右缘第3、4肋间
E. 左侧腋前线3、4肋间

正确答案：C。胸骨左缘第3、4肋间

解析：心包摩擦音指脏层与壁层心包由于生物性或理化因素致纤维蛋白沉积而粗糙，以致在心脏搏动时产生摩擦而出现的声音，音质粗糙、高音调、搔抓样、比较表浅，类似纸张摩擦的声音，在心前区或胸骨左缘第3、4肋间最响亮（C对），坐位前倾及呼气末更明显。典型者摩擦音的声音呈三相：心房收缩-心室收缩-心室舒张期，但多为心室收缩-心室舒张的双期摩擦音，有时也可仅出现在收缩期。心包摩擦音与心搏一致，屏气时摩擦音仍存在，可据此与胸膜摩擦音相鉴别。